造成化妆品有毒化学物质污染的主要物质是
A. 有毒重金属
B. 硫代甘醇酸
C. 氨基苯甲醚
D. 硝基二乙醇胺
E. 二甲基亚砜

正确答案：A。有毒重金属